关于屈光装置的描述中，何者是错误的
A. 屈光装置包括角膜、房水、晶状体、玻璃体
B. 外界物体经屈光装置在视网膜上成像称正视
C. 若眼轴过长，物像落在视网膜后方称近视
D. 矫正近视需戴凹透镜
E. 以上均不对

正确答案：C。若眼轴过长，物像落在视网膜后方称近视

解析：屈光装置包括角膜、房水、晶状体、玻璃体（A对），外界物体经屈光装置在视网膜上成像称正视（B对）。近视是指眼轴过长或屈光装置的屈光率过强，导致物像落在视网膜前方，而非后方（C错，为本题正确答案）。矫正近视目前的思路是使进入眼球的光线发散，即矫正近视需戴凹透镜（D对）。